微热脉浮消渴小便不利之证，宜选
A. 苓桂术甘汤
B. 真武汤
C. 桂枝去桂加茯苓白术汤
D. 五苓散
E. 茯苓甘草汤

正确答案：D。五苓散

解析：太阳病用汗法，本属正治，但若汗出太多，则属汗不如法。本条文首所说“太阳病，发汗后，大汗出”，便是汗不如法。汗出太多，可产生两种变化。一是汗后外邪虽解，却因汗出太多，损伤津液，出现了“胃中干”。从后文“欲得饮水者，少少与饮之”来看，此证当属一时性的津液不足，胃中干思水滋燥，则必见口渴欲饮之症状。胃乏津液之滋而不和，胃不和则卧不安，故可见烦躁不得眠。此时的救治之法是“欲得饮水者，少少与饮之”，“少少与饮”，即少量频饮，这既是为了滋其胃燥，复其津液，又是为了防止过饮停水，发生他变。二是汗后见脉浮、小便不利、微热、消渴等症。脉浮、微热者；是汗虽大出，但表证未解，另从“微热”可知其证当有所减轻。小便不利、消渴，原非太阳表证的症状，今在汗后见之者，是太阳表邪不解，循经入腑，影响膀胱气化功能，水蓄下焦所致。气化失司，水不下排，则小便不利，由于水停于内，故多兼少腹胀满；水停下焦，津不上承，则见渴欲饮水。但因气化不利，饮水后津液不能布达，口渴不除，因此形成所谓的“消渴”。本证是外有太阳表邪不解，内有膀胱蓄水，故用五苓散化气行水，两解表里（D对）。